RPA卡环组与RPI卡环组不同点是用圆环形卡环的固位臂代替Ⅰ杆。可用于
A. 基牙舌向倾斜，颊侧无倒凹者
B. 基牙向近中倾斜，颊侧远中无倒凹者
C. 基牙向远中倾斜，颊侧近中无倒凹者
D. 口底过浅者
E. 前庭沟过浅或存在颊侧组织倒凹者

正确答案：E。前庭沟过浅或存在颊侧组织倒凹者

解析：本题考查RPA卡环的适应证。I杆从龈方向（牙合）方，终止于唇颊侧基牙外形高点线以下的有利倒凹内，当前庭沟过浅不足以容纳I杆的高度容易显露金属时考虑使用圆环形卡环；I杆发挥作用时会向龈方移动，不能对牙龈造成压迫，需要进行缓冲，当颊侧存在组织倒凹时，杆形卡环的功能性运动会压迫软组织造成疼痛，此时也要考虑使用圆环形卡环（E对）。基牙向舌侧倾斜，颊侧无倒凹者，不能使用RPA卡环组或RPI卡环组，圆环形卡环和I杆都是位于基牙颊侧的有利倒凹内（AD错）。使用RPA卡环时要求基牙排列正常，观测线位于牙冠正中，可获得颊侧近远中两个倒凹，如果基牙向近中倾斜，功能运动是远中邻面板会优先于近中（牙合）支托起作用，加大对基牙的扭力（B错）。RPA卡环组的圆环形卡环是从义齿基托或固位网发出，固位臂尖应位于颊侧近中的有利倒凹，基牙向远中倾斜，颊侧近中无倒凹者无法应用RPA卡环组（C错）。